来源于五加科的药材有
A. 玄参
B. 人参
C. 三七
D. 太子参
E. 西洋参

正确答案：B、C、E。人参；三七；西洋参

解析：本题考查的是人参、三七与西洋参的来源。来源于五加科的药材有人参（B对）、三七（C对）与西洋参（E对）。人参：【来源】为五加科植物人参的干燥根和根茎。西洋参：【来源】为五加科植物西洋参的干燥根。三七：【来源】为五加科植物三七的干燥根和根茎。玄参（A错）：【来源】为玄参科植物玄参的干燥根。太子参（D错）：【来源】为石竹科植物孩儿参的干燥块根。